相对危险度是
A. 暴露组发病率减去非暴露组发病率
B. 暴露组的发病率（死亡率）除以非暴露组的发病率（死亡率）
C. 暴露组的死亡率加非暴露组的死亡率
D. 病例组有某因素的比例减去对照组有某因素的比例

正确答案：B。暴露组的发病率（死亡率）除以非暴露组的发病率（死亡率）

解析：本题考查相对危险度的概念。相对危险度（RR）通常包括了危险度比或率比。危险度比是暴露组的危险度（测量指标是累积发病率）与对照组的危险度之比（B对ACD错）。率比是暴露组与对照组的发病密度之比。危险度比和率比都是反映暴露与发病（死亡）关联强度的最有用的指标。